部分激动剂的特点是
A. 与受体亲和力高，但无内在活性
B. 与受体亲和力弱，但内在活性较强
C. 与受体亲和力和内在活性均较弱
D. 与受体亲和力高，但内在活性较弱
E. 对失活态的受体亲和力大于活化态

正确答案：D。与受体亲和力高，但内在活性较弱

解析：本题考查部分激动剂的特点。部分激动剂的特点是与受体亲和力高，但内在活性较弱（D对）。部分激动药具有较强亲和力，但内在活性低（α＜1），与受体结合后只能产生较弱的效应。与受体亲和力高，但无内在活性（A错）的是拮抗药。对失活态的受体亲和力大于活化态（E错）的是反向激动药。